女，15岁。阴道淋漓流血2个月，既往月经不规律，周期长短不一，尿妊娠实验阴性，其基础体温最可能是
A. 基础体温呈双相型，持续高温期
B. 基础体温呈双相型，高温期短于11天
C. 基础体温呈双相型，下降缓慢
D. 基础体温呈双相型，上升缓慢
E. 基础体温呈单相型

正确答案：E。基础体温呈单相型

解析：青春期女性（无排卵性子宫出血高发年龄），月经不规律，阴道淋漓流血，尿妊娠实验阴性（排除妊娠），据患者年龄及临床表现，最可能是无排卵性异常子宫出血。无排卵性子宫出血高发于青春期，因青春期下丘脑－垂体－卵巢轴反馈调节不成熟，FSH处于低水平，进而不能诱发功能性排卵，使循环血中雌孕激水平低下。孕激素有提高中枢兴奋性，升高基础体温的作用，因此基础体温呈单向型 （E对）是诊断无排卵性AUB最常用的手段。基础体温呈双相型，高温期短于11天（B错）见于由黄体功能不全导致的排卵性异常子宫出血，患者常常月经周期缩短（P339）；基础体温呈双相型，下降缓慢（C错）见于由子宫内膜不规则脱落导致的排卵性异常子宫出血，患者月经周期正常，但经期延长（P340）。